阴阳转化的内在根据是
A. 交合感应
B. 对立制约
C. 消长平衡
D. 互根互用
E. 无限可分

正确答案：D。互根互用

解析：本题考查的是阴阳的互根互用。阴阳转化的内在根据是互根互用（D对）。阴阳的互根互用，是阴阳转化的内在根据。由于阴和阳本来就是相互关联事物的对立双方，或本是一个事物内部的对立双方，因而阴和阳在一定的条件下，可以各自向着自己相反的方面转化。阴阳对立（B错），是指事物或现象中阴与阳两个方面，具有阴阳相反、相互制约的关系，又称“阴阳对待”。阴阳学说认为，自然界一切事物或现象都存在着相互对立、相反相成的两个方面。阴阳的消长平衡（C错），是指在一定的限度内，阴或阳的运动变化出现减少或增加的量变形式。